下列有关潴留性黏液囊肿的描述中，正确的是
A. 有上皮衬里
B. 结缔组织被膜
C. 潴留的黏液团块
D. 导管系统部分阻塞所致
E. 以上说法均正确

正确答案：E。以上说法均正确

解析：潴留性黏液囊肿：远不如外渗性黏液囊肿常见。组织学表现有三个特点：有上皮衬里、潴留的黏液团块及结缔组织被膜。潴留性黏液囊肿的发病原因主要是导管系统的部分阻塞，可由微小涎石、分泌物浓缩或导管系统弯曲等原因所致。掌握“舌下腺及唾液腺黏液囊肿”知识点。